消费者购买药品时，执业药师有权以更经济的其他商品名的该种药品进行替换的情况是
A. 该药品不属于医疗保险用药
B. 该药品属于处方药
C. 该药品属于特殊管理的药品
D. 该药品属于贵重药品
E. 保证药品质量和疗效等同并且购药者要求或同意

正确答案：E。保证药品质量和疗效等同并且购药者要求或同意

解析：本题考查执业药师。消费者购买药品时，执业药师有权以更经济的其他商品名的该种药品进行替换的情况是保证药品质量和疗效等同并且购药者要求或同意（E对）。